属于四环素类抗生素的是
A. 阿米卡星
B. 红霉素
C. 土霉素
D. 阿昔洛韦
E. 利福喷丁

正确答案：C。土霉素

解析：本题考查四环素类抗生素。土霉素（C对）为四环素类抗生素。阿米卡星（A错）为氨基糖苷类抗生素。红霉素（B错）为大环内脂类抗生素。阿昔洛韦（D错）为一种合成的嘌呤核苷类似物，是核苷类抗病毒药。利福喷丁（E错）抗菌谱性质与利福平相同，对结核杆菌、麻风杆菌、金黄色葡萄球菌等微生物有抗菌作用。